患者青壮年，咳嗽伴低热、盗汗，、乏力1个月。X线显示右肺上可见大小不等、密度不均、模糊斑片状阴影。应首先考虑的是
A. 渗出性胸膜炎
B. 血行播散型肺结核
C. 浸润型肺结核
D. 慢性纤维空洞型肺结核
E. 原发型肺结核

正确答案：C。浸润型肺结核

解析：咳嗽伴低热，盗汗，乏力为肺结核的典型表现，X线显示右肺上可见大小不等、密度不均、模糊斑片状阴影，故可以诊断为浸润性肺结核（C对）。渗出性胸膜炎（A错）的表现为呼吸困难，胸痛，咳嗽，X线发现少量胸腔积液。血行播散型肺结核（B错）的特点为起病急，高热寒战等中毒症状，全身浅表淋巴结肿大，肝脾肿大，常伴发结核性脑膜炎。慢性纤维空洞型肺结核（D错）的特点为干酪渗出病变溶解而形成虫蚀样空洞。原发型肺结核（E错）X线胸片表现为哑铃状病灶，肺部原发病灶、引流淋巴管炎和肿大的肺门淋巴结组成典型的原发综合征。